不属左心室结构的是
A. 二尖瓣
B. 动脉圆锥
C. 肉柱
D. 腱索
E. 乳头肌

正确答案：B。动脉圆锥

解析：二尖瓣（A对）、肉柱（C对）、腱索（D对）、乳头肌（E对）均属左心室结构。动脉圆锥（B错，为本题正确答案）属右心室结构。